病人发生甲状腺机能亢进时，其I¹³¹摄取率2小时至少超过
A. 15%
B. 20%
C. 25%
D. 30%
E. 35%

正确答案：C。25%

解析：病人发生甲状腺机能亢进时，其2小时内甲状腺摄取¹³¹I量超过人体总量的0.25（C对），或在24小时内超过人体总量的0.5，且吸收¹³¹I高峰提前出现。